木通的药用部位是
A. 心材
B. 含有树脂的木材
C. 茎髓
D. 藤茎
E. 茎枝

正确答案：D。藤茎

解析：本题考查的是木通的来源。木通的药用部位是藤茎（D对）。木通：【来源】为木通科植物木通、三叶木通或白木通的干燥藤茎。心材（A错）为木类中药的常用部位。木类中药多采用心材部分，如沉香、降香、檀香、苏木等。药用部位为含有树脂的木材（B错）的中药是沉香。沉香：【来源】为瑞香科植物白木香含有树脂的木材。药用部位为茎髓（C错）的中药有通草、灯心草。药用部位为茎枝（E错）的中药有桑寄生、槲寄生。